疣是一种在皮肤浅表的赘生物，发生胸背、中有脐窝的赘疣称为
A. 千日疮
B. 疣目
C. 鼠乳
D. 扁瘊
E. 跖疣

正确答案：C。鼠乳

解析：疣是一种发生于皮肤浅表的良性赘生物，因皮损形态及发病部位的不同而名称各异。其中发于胸背部有脐窝的赘疣目，称为鼠乳（C对）；发于手背、手指、头皮等处者，称为千日疮（A错）、疣目（B错）；发于颜面、手背、前臂等处者，称为扁瘊（D错）；发于足跖部者，称为跖疣（E错）。